患儿，2岁。形体极度消瘦，面呈老人貌，皮包骨头，腹凹如舟，精神萎靡，大便溏薄，舌淡苔薄腻。其证候是
A. 疳肿胀
B. 疳气
C. 疳积
D. 干疳
E. 心相

正确答案：D。干疳

解析：形体极度消瘦，面呈老人貌，皮包骨头，腹凹如舟，精神萎靡，大便溏薄，舌淡苔薄腻，诊断为干疳（D对）。疳肿胀以形体消瘦，伴肢体浮肿，按之凹陷难起为特征（A错）。疳气以形体略瘦，食欲不振为特征（B错）。疳积以腹大肢细为典型体征（C错）。心相指心之外在表现，与题干不符（E错）。